在听力曲线图上呈V形下陷频段是
A. 1000～3000赫兹
B. 2000～6000赫兹
C. 4000～6000赫兹
D. 6000～8000赫兹
E. 3000～6000赫兹

正确答案：E。3000～6000赫兹

解析：本题考查听力曲线V形下陷频段。噪声引起的永久性听阈位移早期常表现为高频听力下降，听力曲线在3000～6000㎐（E对ABCD错）（多在频率4000㎐）出现“V”型下陷，又称听谷。此时病人主观无耳聋感觉，交谈和社交活动能够正常进行。